某化工厂工人，在一次事故中出现恶心、呕吐、震颤等急诊住院。查体：皮肤黏膜呈樱桃红色，呼出气中有苦杏仁味，疑为急性职业中毒，最可能是
A. 一氧化碳
B. 苯胺
C. 硫化氢
D. 砷化氢
E. 氰化物

正确答案：E。氰化物